UGC、UGU可编码半胱氨酸属于密码的
A. 摆动性
B. 通用性
C. 连续性
D. 简并性
E. 特异性

正确答案：D。简并性